股骨颈骨折pauwels角指
A. 股骨颈长轴线与股骨干纵轴线之间形成的夹角
B. 股骨颈长轴线与股骨颈骨折线之间的夹角
C. 股骨颈骨折线与股骨干纵轴线之间的夹角
D. 股骨颈骨折线与两大转子连线之间的夹角
E. 股骨颈骨折线与两髂嵴连线之间的夹角

正确答案：E。股骨颈骨折线与两髂嵴连线之间的夹角

解析：股骨颈骨折pauwels角指股骨颈骨折线与两侧髂嵴连线之间的夹角（E对BCD错）。股骨颈长轴线与股骨干纵轴线之间形成的夹角是股骨的颈干角（A错）。